麻黄汤适用于
A. 风寒闭肺喘证
B. 痰热郁肺喘证
C. 肾虚作喘喘证
D. 肺脾两虚喘证
E. 肺肾阴虚喘证

正确答案：A。风寒闭肺喘证

解析：本题考查的是喘证的辨证论治。麻黄汤适用于风寒闭肺喘证（A对）。喘即气喘、喘息。喘证是以呼吸困难，甚至张口抬肩、鼻翼扇动、不能平卧为特征的疾病。（一）风寒闭肺证：【方剂应用】基础方剂为麻黄汤（麻黄、杏仁、桂枝、炙甘草）合华盖散（麻黄、杏仁、桑白皮、紫苏子、茯苓、陈皮）加减。（二）痰热壅肺证（B错）：【方剂应用】基础方剂为桑白皮汤（桑白皮、半夏、苏子、苦杏仁、贝母、黄芩、黄连、栀子）加减。（三）痰浊阻肺证：【方剂应用】基础方剂为二陈汤（陈皮、半夏、茯苓、甘草、生姜、乌梅）合三子养亲汤（紫苏子、白芥子、莱菔子）加减。（四）肾不纳气证：【方剂应用】基础方剂为肾气丸（桂枝、附子、熟地、山萸肉、山药、茯苓、丹皮、泽泻）合参蛤散（人参、蛤蚧）加减。肾虚作喘喘证（C错）可用金匮肾气丸治疗。用金匮肾气丸治疗肾虚作喘，但若久治不愈，阳损及阴，兼见咽干烦躁者，又当配麦味地黄丸、生脉散或参蛤散同用，以平调阴阳、纳气平喘，且防止金匮肾气丸燥烈伤阴，降低副作用。肺脾两虚证（D错）与肺肾阴虚证（E错）临床常见咳嗽，而不是喘证。肺脾两虚证的临床表现，常见久咳不已，短气乏力，痰多清稀，食纳减少，腹胀便溏，甚则足面浮肿，舌淡苔白，脉细弱。一般以咳喘、纳少、腹胀便溏为主，伴见气虚症状为辨证要点。肺肾阴虚证的临床表现，常见咳嗽痰少，动则气促，间或咯血，腰膝酸软，消瘦，骨蒸潮热，盗汗遗精，颧红，舌红苔少，脉细数。